医疗机构注册不需登记的信息
A. 人员
B. 药占比
C. 床位
D. 注册资金
E. 设计平面图

正确答案：B。药占比

解析：医疗机构执业登记的事项是：①类别、名称、地址、法定代表人或者主要负责人（A对）；②所有制形式：③注册资金（资本）（D对）：④服务方式：⑤诊疗科目：⑥房屋建筑面积（E对）、床位（C对）（牙椅）；⑦服务对象：⑧职工人数：⑨执业许可证登记号（医疗机构代码）等。门诊部、诊所、卫生所、医务室、卫生保健所、卫生站还应当核准附设药房（柜）的药品种类。故答案选择药占比（B错，为本题正确答案）。